治疗痿证使用泻南方、补北方的原则，是因为该病
A. 寒多热少，虚多实少
B. 热多寒少，虚多实少
C. 热多寒少，实多虚少
D. 寒多热少，实多虚少
E. 以上均非

正确答案：B。热多寒少，虚多实少

解析：痿证是指肢体筋脉弛缓，软弱无力，不能随意运动，或伴肌肉萎缩的一种病证。《儒门事亲》认为：“痿证是由于肾水不能胜心火，心火上铄肺金，肺金受火制，六叶皆焦，皮毛虚弱，急而薄者，则生痿躄”。泻南即泻心火，提示该病为热多寒少；补北即补肾水（阴），提示该病为虚多实少（B对）。